10％α-萘酚乙醇溶液再加硫酸用于检查
A. 菊糖
B. 黏液
C. 草酸钙结晶
D. 碳酸钙结晶
E. 硅质

正确答案：A。菊糖